Down综合征患者发生严重的牙周炎的比例是
A. 1
B. 0.95
C. 0.9
D. 0.85
E. 0.8

正确答案：A。1

解析：本题考查Down综合征的临床表现。Down综合征是染色体异常所引起的先天性疾病，几乎100％（A对）患者均有严重的牙周炎，且其牙周破坏程度远超过菌斑、牙石等局部刺激的量，可能与细胞介导和体液免疫缺陷以及吞噬系统缺陷有关。